患者，男，82岁，诊断为帕金森病，给予左旋多巴联合卡比多巴治疗，产生的药物相互作用属于
A. 敏感化作用，药品不良反应增加
B. 降低抗药性，疗效增加
C. 拮抗作用，药品不良反应增加
D. 增加靶器官药物浓度，药品不良反应減少
E. 拮抗作用，药品不良反应減少

正确答案：D。增加靶器官药物浓度，药品不良反应減少

解析：本题考查药物的相互作用。增加靶器官药物浓度，药品不良反应減少（D对）为左旋多巴与卡比多巴联合应用产生的相互作用。降低抗药性，疗效增加（B错）为青蒿素和乙胺嘧啶联合治疗疟疾，产生的药物相互作用。敏感化作用，药品不良反应增加（A错）为氢氯噻嗪与地高辛联合应用产生的相互作用。拮抗作用，药品不良反应增加（C错）是指两种药物在同一作用部位或受体上发生拮抗，如甲苯磺丁脲与氢氯噻嗪联合应用。拮抗作用，药品不良反应減少（E错）是指两种药物在不同作用部位或受体上发生拮抗。